肠道传染病夏季高发，呼吸道传染病冬春季高发
A. 短期波动
B. 季节性
C. 周期性
D. 长期趋势
E. 变化浮动

正确答案：B。季节性

解析：疾病在一定季节内呈现发病率增高的现象称为季节性。肠道传染病夏季高发，呼吸道传染病冬春季高发，均强调疾病在一定季节内发病率增高，这种现象为季节性（B对）。